正常小儿白细胞分类出现两次中性粒细胞与淋巴细胞比例相等的年龄是
A. 1~3天和2~3岁
B. 4~6天和4~6岁
C. 7~9天和7~9岁
D. 10-15天和8~9岁
E. 15-20天和9~10岁

正确答案：B。4~6天和4~6岁

解析：小儿末梢血中性粒细胞和淋巴细胞的比例相等的时间分别是4-6天和4-6岁（B对）。